经间期出血具有而赤带不具有的特点是
A. 持续时间较长
B. 接触性出血史
C. 明显的周期性
D. 反复发作
E. 可见宫颈糜烂

正确答案：C。明显的周期性

解析：经间期出血有明显的周期性，大多出现在月经周期的第10～16天，一般可自行停止；赤带在月经周期任何一个时间段均可能出血，无周期性（C对），出血量少，持续时间长或反复发作（AD错），妇科检查常见宫颈糜烂（E错）、宫颈赘生物或子宫、附件区压痛明显。